治疗药物监测的意义不包括
A. 控制药品质量，增强市场竞争力
B. 改进检查方法，提高监测水平
C. 促进新药开发，提供可靠的申报资料
D. 改进老药质量，为设计新处方提供数据
E. 指导临床合理用药，实现给药方案个体化

正确答案：B。改进检查方法，提高监测水平